当切口两侧进出针间距大于皮下间距时可引起
A. 死腔形成
B. 术后开裂
C. 愈合瘢痕直线收缩
D. 瘢痕增粗
E. 皮肤创缘内卷

正确答案：E。皮肤创缘内卷

解析：本题考查缝合。正确缝合应使皮肤切口两侧进出针间距等于或略小于皮下间距，如切口两侧进出针间距大于皮下间距，易造成皮肤创缘内卷（E对）；相反，进出针间距小于皮下间距则皮肤创缘呈现过度外翻，都会影响创口的愈合。死腔形成（A错）多是由两侧组织不等量，不对称引起的。术后开裂（B错）可由较大张力缝合、打结过紧等引起。愈合瘢痕直线收缩（C错）多由在功能部位（如口角、下睑等）进行过长的直线缝合引起。瘢痕增粗（D错）多由缝合时打结过松所引起。